某住户全家因食物中毒住院，经调查，可疑食物为卤猪肉，病人潜伏期多为10～12小时，主要临床症状为恶心、呕吐、头晕、头痛、乏力，并伴有阵发性剧烈腹痛，腹泻多呈水样便并伴有黏液、恶臭，少数病人有面部及全身皮肤潮红，体温大多低于39℃，可初步诊断为
A. 沙门菌属食物中毒
B. 副溶血性弧菌食物中毒
C. 组胺食物中毒
D. 亚硝酸盐食物中毒
E. 变形杆菌食物中毒

正确答案：E。变形杆菌食物中毒